已获得的知识、技能和方法对解决新问题会产生影响的心理现象称为
A. 暗示
B. 功能固着
C. 保持
D. 迁移
E. 创造

正确答案：D。迁移

解析：此题为概念题。迁移（D对）指的是一种学习对另一种学习的影响，指在一种情境中获得的技能、知识或态度对另一种情境中技能、知识的获得或态度的形成的影响。